兴奋性是机体或组织对刺激
A. 发生应激的特性
B. 发生反应的特性
C. 产生适应的特性
D. 引起反射的特性
E. 引起内环境稳态的特性

正确答案：B。发生反应的特性